（牙合）支托是卡环伸向基牙（牙合）面的部分，防止义齿移位的方向为
A. （牙合）向
B. 近中向
C. 远中向
D. 龈向
E. 颊向

正确答案：D。龈向

解析：（牙合）支托：是卡环伸向基牙（牙合）面而产生支持作用的部分，防止义齿龈向移位，可保持卡环在基牙上的位置。掌握“局部义齿固位体”知识点。